健康教育的实质是
A. 卫生宣传
B. 预防疾病
C. 促进健康
D. 提高生活质量
E. 一种干预

正确答案：E。一种干预